急性心衰时不可能发生下列哪项代偿
A. 心率增快
B. 心脏扩张
C. 交感神经兴奋
D. 血液重新分配
E. 心肌肥大

正确答案：E。心肌肥大

解析：急性心衰时，心脏本身可通过功能调节如心率加快（A错）、心脏扩张（B错）和心肌收缩性增强，以快速进行代偿。同时，因交感神经兴奋（C错），外周血管选择性收缩，使全身血液重新分配（D错）。慢性心衰时，心室通过慢性综合性适应性反应即心室重塑（结构调节）进行代偿，心室重塑包括心肌细胞重塑和心肌间质重塑，而心肌细胞重塑则表现为心肌肥大和心肌细胞表型改变。因此，心肌肥大（E对）是心脏长期代偿引起的改变，不可能发生在急性心衰时。